患者，女，26岁，已婚。妊娠3个月，尿少色黄，尿时艰涩而痛，心烦，口舌生疮，舌红少苔，脉数。治疗应首选
A. 导赤散
B. 加味五苓散
C. 知柏地黄汤
D. 清热通淋汤
E. 以上均非

正确答案：A。导赤散

解析：患者妊娠三个月，尿时艰涩而痛，是为妊娠小便淋痛；心烦，口舌生疮，舌红少苔，脉数是心火偏旺之象，故用导赤散以清心泻火，润燥通淋（A对）。加味五苓散功效清热利湿，润燥通淋，用于妊娠小便淋痛湿热下注证，原方治疗阴肿（B错）。知柏地黄汤功效滋肾益阴，清热利湿，用于妊娠小便淋漓阴虚津亏证（C错）。清热通淋汤功效清肝利热，利水通淋，用于妊娠肝经郁热，小便黄赤，艰涩不利，常见解时疼痛，频数而短，面色微红，头晕耳鸣，口苦而干，烦躁不安，大便燥结，带下黄色，舌红，苔厚黄而燥，脉滑数有力（D错）。